转基因食品的卫生问题一般不需要考虑
A. 食品的营养改变
B. 对人体健康的间接影响
C. 食品性状改变情况
D. 食品中基因改变
E. 对于食品保质期的影响

正确答案：E。对于食品保质期的影响